治瘀血证的药物是
A. 芒硝
B. 大黄
C. 二者均是
D. 二者均不是

正确答案：B。大黄

解析：本题考查的是大黄的主治病证。治瘀血证的药物是大黄（B对）。大黄：【主治病证】（1）大便秘结，胃肠积滞，湿热泻痢初起。（2）火热上攻之目赤、咽喉肿痛、口舌生疮、牙龈肿痛。（3）热毒疮肿，水火烫伤。（4）血热之吐血、衄血、咯血、便血。（5）瘀血闭经，产后瘀阻腹痛，癥瘕积聚，跌打损伤。（6）湿热黄疸，淋证涩痛。芒硝（A错）：【主治病证】（1）实热积滞，大便燥结。（2）咽喉肿痛，口舌生疮，目赤肿痛，疮疡，乳痈，肠痈，痔疮肿痛。